下列病证中，适用标本兼治的是
A. 伤食泄泻
B. 热结便秘
C. 虚人感冒
D. 肺热咳嗽
E. 虚寒胃痛

正确答案：C。虚人感冒

解析：本题考查的是标本兼治。下列病证中，适用标本兼治的是虚人感冒（C对）。标本兼治，指在标本俱急、或标本俱缓时，当标本同时进行治疗。如身热、腹硬满痛、大便燥结、口干渴、舌燥苔焦黄等，此属邪热里结为标，阴液受伤为本，标本俱急，治当标本兼顾，可用增液承气汤治之。又如虚人感冒，素体气虚，反复外感，治宜益气解表，益气为治本，解表为治标。寒下法适用于热结便秘（B错）证。症见高热谵语，大便秘结，腹胀腹痛，口舌干燥。舌红，苔黄或黄燥，脉滑数。